比较理想的阻滞麻醉剂是
A. 普鲁卡因
B. 利多卡因
C. 地卡因
D. 可卡因
E. 氯乙烷

正确答案：B。利多卡因

解析：利多卡因又名赛洛卡因，局麻作用较普鲁卡因强，维持时间亦较长，并有较强的组织穿透性和扩散性，故亦可用作表面麻醉。掌握“颌面部常用局部麻醉药物”知识点。